与右心房无关的是
A. 肉柱
B. 梳状肌
C. 冠状窦口
D. 卵圆窝
E. 出口为右房室口

正确答案：A。肉柱

解析：肉柱（A错，为本题正确答案）位于右心室，与右心房无关，为纵横交错的肌性隆起，故腔面凹凸不平。